农村发现甲类传染病及乙类的艾滋病，肺炭疽、病原携带者或疑似病人的报告时限为
A. 6小时以内
B. 12小时以内
C. 24小时以内
D. 36小时以内
E. 3天以内

正确答案：A。6小时以内

解析：本题考查传染病的报告时限。责任疫情报告人发现甲类传染病或乙类传染病中的艾滋病、肺炭疽病人、病原携带者或疑似病人时，城镇应于2小时内，农村应于6小时内（A对BCDE错）报告给发病地区所属的县（区）卫生防疫机构。